患者双乳肿块疼痛，月经前加重，经后减轻，肿块大小不等，伴乳头溢液，月经不调，腰酸乏力，舌淡苔白，脉弦细。其证候是
A. 肝气郁结
B. 肝郁淡凝
C. 冲任失调
D. 肝郁脾虚
E. 肝郁火旺

正确答案：D。肝郁脾虚

解析：患者双乳肿块疼痛，为肝气郁结，日久瘀滞成块，不通则痛；月经将至，冲任气血凝聚而不通，故经期乳房疼痛加重；积郁成结，乳汁疏泄受阻，故出现乳头溢液；月经不调，腰酸乏力为脾肾亏虚；舌淡苔白，脉弦细为肝郁脾虚典型舌脉表现（D对）。患者主症经前乳痛，伴腰酸乏力，为虚实夹杂证，肝气郁结（A错）、肝郁痰凝（B错）、肝郁火旺（E错）均为实证。冲任失调（C错）主要表现为月经紊乱，以月经先期、月经后期、或月经先后不定期为主要临床表现。